体细胞转变为癌细胞需要
A. 癌基因和肿瘤抑制基因的活化
B. 癌基因和肿瘤抑制基因的灭活
C. 癌基因的活化和肿瘤抑制基因的灭活
D. 癌基因的灭活和肿瘤抑制基因的活化
E. 癌基因的活化和DNA修复基因的活化

正确答案：C。癌基因的活化和肿瘤抑制基因的灭活